由器质性病变导致的长期开口困难称为
A. 癔病性牙关紧闭
B. 咀嚼肌群痉挛
C. 颞下颌关节强直
D. 破伤风后牙关紧闭
E. 关节盘移位

正确答案：C。颞下颌关节强直

解析：本题考查器质性病变。颞下颌关节强直（C对）是指颞下颌关节和关节周围及颌间部位，由于纤维疤痕或骨性粘连，致使下颌骨运动障碍或下颌骨不能运动，故由器质性病变导致的长期开口困难为颞下颌关节强直。引起长期开口困难癔病性牙关紧闭（A错）是由精神因素引起的牙突然紧闭，无器质性病变。咀嚼肌群的痉挛（B错）主要为咀嚼肌的功能不协调，关节的结构本身正常，无器质性病变。破伤风牙关紧闭（D错）是由破伤风杆菌引起的急性感染而引起肌肉的痉挛，无器质性病变。关节盘移位（E错）是由于关节盘、髁突和关节窝之间的正常结构关系紊乱，亦无关节器质性破坏。